作用于用于尖牙，尤其是下颌尖牙的卡环为
A. 连续卡环
B. 尖牙卡环
C. 双臂卡环
D. 三臂卡环
E. 圈形卡环以上为锻丝卡环的各种类型

正确答案：B。尖牙卡环

解析：尖牙卡环：用于尖牙，尤其是下颌尖牙。卡环由近中切支托顺舌面近中边缘嵴向下，经舌隆突、舌面远中边缘嵴向上至远中切角，向下向前进入唇面近中倒凹。掌握“局部义齿固位体”知识点。